内源性凝血途径的始动因子是
A. 因子Ⅻ
B. 因子Ⅱ
C. 因子X
D. 因子Ⅲ
E. 因子Ⅶ

正确答案：A。因子Ⅻ